男，16岁。在一次考试中成绩很差，使他很受打击、情绪低落。老师告诉他没关系，这次考试只是一次阶段性考核，还可以通过复习将不会的知识点搞清楚，该生的情绪因此得到很大改善。导致其情绪改善的主要原因是
A. 改变了认知
B. 调整了防御方式
C. 改变了环境
D. 改变了意志
E. 学会了放松

正确答案：A。改变了认知

解析：该生在一次考试中成绩很差，很受打击、情绪低落。但老师告诉他只是一次阶段性考核，还可以通过复习将不会的知识点搞清楚，该生的情绪因此得到很大改善。导致其情绪改善的主要原因是改变了认知（A对）。